治疗军团菌病的首选药物是
A. 麦迪霉素
B. 红霉素
C. 土霉素
D. 多西环素
E. 四环素

正确答案：B。红霉素

解析：本题考查抗菌药物的适应症。治疗军团菌病的首选药物是红霉素（B对）。红霉素对于军团菌病、支原体肺炎、空肠弯曲菌肠炎等疾病，都是首选用药。麦迪霉素（A错）用于治疗呼吸道感染、泌尿系统感染、支原体肺炎感染等。土霉素（C错）用于治疗青霉素类抗生素过敏的破伤风、气性坏疽等。多西环素（D错）用于治疗立克次体病、支原体感染、衣原体感染等。四环素（E错）是治疗立克次体病的首选药物。